女，40岁。孕30周单胎畸形，入院行引产术。婚育史：孕4产1。査体：T37.5度，BP135/80mmHg。实验室检査：Hb73g/L，WBC8.2×l0⁹/L，Plt200×10⁹/L，ABO血型为A型，Rh血型CCdEE。术前为改善贫血应输注
A. A型RhD阳性悬浮红细胞
B. AB型RhD阴性悬浮红细胞
C. B型RhD阴性悬浮红细胞
D. 0型RhD阳性悬浮红细胞
E. A型RhD阴性悬浮红细胞

正确答案：E。A型RhD阴性悬浮红细胞

解析：输血原则为坚持同型输血，Rh血型系统是红细胞血型中最复杂的一个系统，与临床关系密切的Rh因子有五种，按抗原性的强弱依次为D、E、C、c、e，D抗原的抗原性最强，一般将红细胞上含有D抗原者称为Rh阳性，而红细胞上缺乏D抗原者称为Rh阴性。患者ABO血型为A型；Rh血型CCdEE，即为RhD阴性。该患者为A型RhD阴性血，所以应该输注A型RhD阴性悬浮红细胞（E对）。